中国药典对药品质量标准含量（效价）限度的说法，错误的是
A. 原料药的含量限度是指有效物质所占百分比
B. 制剂含量限度一般用含量占标示量的百分率表示
C. 制剂效价限度一般用效价占标示量的百分率表示
D. 抗生素效价限度一般用重量（mg）表示
E. 原料药含量测定的百分比一般是指重量百分比

正确答案：C。制剂效价限度一般用效价占标示量的百分率表示

解析：本题考查药品标准检查项下的内容。中国药典对药品质量标准含量（效价）限度的说法，错误的是制剂效价限度一般用效价占标示量的百分率表示（C错，为本题正确答案）。对于原料药，用“含量测定”的药品，其含量限度均用有效物质所占的百分数（%）表示（A对）。此百分数，除另有注明者外，均系指重量百分数（E对）。对于制剂，含量（效价）的限度一般用含量占标示量的百分率来表示（B对）。采用＂效价测定”的抗生素或生化药品，其含量限度用效价单位表示（D对）。例如，硫酸庆大霉素效价限度规定为：按无水物计算，每 1mg 的效价不得少于 590 庆大霉素单位；再如，凝血酶冻干粉为牛血或猪血中提取的凝血酶原经激活而得的供口服或局部止血用凝血酶的无菌冻干制品，其效价限度规定为：按无水物计算，每 1mg 凝血酶的活力不得少于10 单位。